以下何脉不主宿食
A. 紧脉
B. 促脉
C. 结脉
D. 滑脉
E. 涩脉

正确答案：C。结脉

解析：结脉多见于阴盛气结、寒痰血瘀，亦可见于气血虚衰等证（C错，为本题正确答案）。宿食积滞，气机不畅，正邪相争剧烈脉失柔和故出现紧脉（A对）。食积等有形实邪阻滞，脉气接续不及，可时见歇止故出现促脉（B对）。食积饮停，皆为阴邪内盛，实邪壅盛于内，气实血涌，故脉见圆滑流利而无滞碍故出现滑脉（D对）。宿食内停，阻滞脉道，气机不畅，血行壅滞，以致脉气往来艰涩，故出现涩脉（E对）。